导致失眠的病因有
A. 阴血不足
B. 心脾两虚
C. 痰火内扰
D. 食滞内停
E. 心火炽盛

正确答案：A、B、C、D、E。阴血不足；心脾两虚；痰火内扰；食滞内停；心火炽盛

解析：本题考查的是失眠的临床意义。导致失眠的病因有阴血不足（A对）、心脾两虚（B对）、痰火内扰（C对）、食滞内停（D对）与心火炽盛（E对）。失眠的临床意义：失眠，是指以经常不易入睡，或睡而易醒不能再睡，或时时惊醒睡不安稳，甚至彻夜不眠为特征的症状，又称“不寐”或“不得眠”。不寐，是阳不入阴、神不守舍的病理表现。其致病原因常见的有两个方面：一是阴血不足、阳热亢盛，以致心神不安、难以入寐，如心肾阴虚、心火炽盛的心烦不寐，心脾两虚、血不养心的心悸怔忡不寐等；一是由于痰火食积诸邪气干扰所致，如胆郁痰扰的失眠、食滞内停的“胃不和则卧不安”等。